关于充分病因-组分病因模型的论述，不正确的是
A. 一个疾病可以有多个充分病因
B. 一个充分病因可以有多个组分病因
C. 对于一个充分病因而言，它的每个组分病因都是必要的，且同样重要
D. 如果一个充分病因的所有组分病因都同时存在，疾病仍可能不会发生
E. 即使某一个充分病因不成立，疾病仍然有可能发生

正确答案：D。如果一个充分病因的所有组分病因都同时存在，疾病仍可能不会发生

解析：本题考查充分病因-组分病因模型的相关内容。一个疾病可以有多个充分病因（A对），一个充分病因可以有多个组分病因（B对）。对于一个充分病因而言，它的每个组分病因都是必要的，且同样重要（C对）。如果一个充分病因的所有组分病因都同时存在，该疾病就一定会发生（D错，为本题正确答案），所有组分病因存在就代表了充分病因的存在，而充分病因又是疾病发生的最小单位，该疾病一定会发生。即使某一个充分病因不成立，疾病仍然有可能发生（E对）。